左室舒张末压3mmHg，肺动脉楔压25mmHg,这种情况见于
A. 主动脉瓣关闭不全
B. 主动脉瓣狭窄
C. 二尖瓣关闭不全
D. 二尖瓣狭窄
E. 肺动脉瓣关闭不全

正确答案：D。二尖瓣狭窄

解析：二尖瓣狭窄（D对）时，舒张期血流由左心房流入左心室受限，左心房压力增高，左心室舒张末期压力减小（正常范围5-6mmHg，本例3mmHg），左心房压力升高导致肺静脉和肺毛细血管压力升高（正常范围6-12mmHg，本例25mmHg）。主动脉瓣关闭不全（A错）、主动脉瓣狭窄（B错）、二尖瓣关闭不全（C错）左心室舒张末期压力增高。肺动脉瓣关闭不全（E错）右心室舒张末期压力增高。